某女，55岁，大便艰涩，排出困难，腹冷腹痛，小便清长，畏寒喜暖，面色无华，舌质淡，苔薄白，脉沉迟。应选用的方剂是
A. 六磨汤加减
B. 麻子仁丸加减
C. 润肠丸加减
D. 半硫丸加减
E. 大承气汤加减

正确答案：D。半硫丸加减

解析：本题考查的是便秘的辨证论治。大便艰涩，排出困难，腹冷腹痛，小便清长，畏寒喜暖，面色无华，舌质淡，苔薄白，脉沉迟。应选用的方剂是半硫丸加减（D对）。便秘是指粪便在肠内滞留过久，秘结不通，排便周期延长，或周期不长，但粪质干结，排出艰难，或粪质不硬，虽有便意，但排而不畅的疾病。西医学的功能性便秘、肠易激综合征、直肠肛门疾患引起的便秘、药物性便秘等，可参考此内容辨证论治。（一）热秘：【症状】大便干结，腹胀腹痛，口干口臭，面红心烦，或有身热，小便短赤。舌红，苔黄燥，脉滑数。【方剂应用】基础方剂为麻子仁丸（麻子仁、芍药、枳实、大黄、厚朴、杏仁）加减（B错）。（二）气秘：【症状】大便干结，或不甚干结，欲便不得出，或便出不爽，胸胁痞满，肠鸣矢气，腹中胀痛，嗳气频作，纳食减少。舌苔薄腻，脉弦。【方剂应用】基础方剂为六磨汤（沉香、木香、槟榔、乌药、枳壳、大黄）加减（A错）。（三）冷秘：【症状】大便艰涩，腹痛拘急，胀满拒按，胁下偏痛，手足不温，呃逆呕吐。舌苔白腻，脉弦紧。【方剂应用】基础方剂为温脾汤（附子、人参、大黄、干姜、甘草）合半硫丸（半夏、硫黄）加减。（四）虚秘：【症状】大便并不干硬，虽有便意，但排便困难，用力努挣则汗出短气，便后乏力，面白神疲，肢倦懒言。舌淡苔白，脉弱。【方剂应用】基础方剂为黄芪汤（黄芪、陈皮、火麻仁、白蜜）加减。方剂应用为润肠丸加减（C错）或大承气汤加减（E错）的病证，2022年考试指南未明确说明。润肠丸：【药物组成】桃仁、羌活、大黄、当归、火麻仁。【功能】润肠通便。【主治】用于实热便秘。大承气汤：【功能】峻下热结。【主治】1.阳明腑实证：大便秘结不通，矢气频转，脘腹痞满而硬，疼痛拒按，日晡潮热，手足溅然汗出，谵语，舌苔焦黄起刺，或焦黑燥裂，脉沉实。2.热结旁流下利清水，色纯青而臭秽，脐腹疼痛，按之坚硬有块，口干舌燥，脉滑实。3.热厥、痉病和狂证而见有里热实证者。